糖尿病毛细血管间肾小球肾炎硬化症在临床上尿液变化的主要特点是
A. 尿糖较前增多
B. 大量血尿
C. 尿中有大量白细胞及管型
D. 持续性蛋白尿
E. 出现酮体

正确答案：D。持续性蛋白尿

解析：糖尿病毛细血管间肾小球肾炎硬化症即糖尿病肾病的一种病理类型，由于肾小球内高压、高灌注、高滤过，早期尿液检查可无异常，后期尿蛋白可持续阳性（D对）。糖尿病可出现尿糖阳性，当进入糖尿病肾病后期，肾小球滤过率下降，肾糖阈升高，尿糖可降低或呈阴性（A错）。大量血尿（B错）多见于原发性肾小球肾炎及IgA肾病，糖尿病肾病多为蛋白尿，血尿少见。尿中有大量白细胞及管型（C错）多见于肾盂肾炎，糖尿病肾病如不合并感染不会出现白细胞及管型。由于糖尿病胰岛素分泌绝对或相对不足，周围组织对葡萄糖糖利用障碍，脂肪动员增加，酮体合成增多，可出现血、尿酮体增加，但其发生与糖尿病肾病无关（E错）。